酒精可引起线粒体脂质过氧化，氯乙烯可引起微粒体脂质过氧化，当二者联合作用于机体时，作用类型为
A. 独立作用（反应相加）
B. 相加作用（剂量相加）
C. 拮抗作用
D. 协同作用
E. 增强作用

正确答案：A。独立作用（反应相加）